乳牙的龋失补牙面数用以下哪种符号表示
A. DMFT
B. DMFS
C. dmft
D. dmfs
E. defs

正确答案：D。dmfs

解析：龋失补指数用龋、失、补牙数（DMFT）或龋、失、补牙面数（DMFS）表示，而乳牙需要使用小写字母进行表示。掌握“龋病流行病学”知识点。